用于治疗疥疮的药物有
A. 克霉唑乳膏、克罗米通乳膏、维A酸软膏
B. 林旦乳膏、硫磺乳膏、克罗米通乳膏
C. 克罗米通乳膏、过氧苯甲酰凝胶、咪康唑软膏
D. 硼酸软膏、咪康唑乳膏、特比萘芬软膏
E. 益康唑乳膏、过氧化氢溶液、维A酸软膏

正确答案：B。林旦乳膏、硫磺乳膏、克罗米通乳膏

解析：本题考查治疗疥疮的药物。林旦乳膏、硫黄软膏、克罗米通乳膏（B对）用于治疗疥疮。疥疮是由疥螨引起，主要通过直接接触传染，也可通过患者用过的衣物间接传染，治疗主要用外用药。维A酸乳膏和过氧苯甲酰凝胶（C错）属于痤疮治疗药。维A酸乳膏（A错）主要用于寻常痤疮，特别是粉刺类损害、扁平疣、皮肤及毛囊角质化异常性病变、寻常型银屑病。过氧苯甲酰凝胶主要用于寻常痤疮。克霉唑、咪康唑（D错）、益康唑（E错）、特比萘芬属于皮肤抗真菌感染药，主要用于浅表真菌感染。